患者，女，40岁。双乳肿胀疼痛，月经前加重，经后减轻，肿块大小不等，形态不一，伴乳头溢液，月经不调，腰酸乏力，舌淡苔白，脉弦细。其证候是
A. 肝郁痰凝
B. 肝气郁结
C. 冲任失调
D. 肝郁火旺
E. 肝郁脾虚

正确答案：C。冲任失调

解析：该患者符合乳癖的特点：单侧或双侧乳房疼痛并出现肿块，乳痛和肿块与月经周期及情志变化密切相关。其冲任失调，上则乳房痰浊凝结，故乳房肿块伴胀痛；下则经水逆乱，故月经周期紊乱，量少色淡，甚或闭经；冲为血海，隶属肝肾，冲任失调，肝气不舒，故经前加重，经水一行，肝气得舒，故经后缓减；肝肾不足，故腰酸乏力；舌、脉也为冲任失调之象（C对）。肝郁痰凝多见于青壮年妇女，乳房肿块，质韧不坚，胀痛或刺痛，随喜怒消长；伴有胸闷胁胀，善郁易怒，失眠多梦，心烦口苦；苔薄黄，脉弦滑（A错）。肝气郁结多伴有胸闷胁胀，或少腹胀闷窜痛，善太息，情志抑郁等（B错）。肝郁火旺可伴见善郁易怒，失眠多梦，心烦目赤等（D错）。肝郁脾虚可伴见食少纳呆，脘腹胀闷，四肢倦怠等，本患者未具（E错）。